西方国家急性胰腺炎最常见的致病因素是
A. 暴饮暴食
B. 酗酒
C. 胆道结石病
D. 胃肠炎
E. 甲状旁腺功能亢进

正确答案：B。酗酒

解析：酗酒（B对）是西方国家急性胰腺炎最常见的致病因素。酒精可促进胰液分泌，当胰管流出道不能充分引流大量胰液时，胰管内压升高，引发腺泡细胞损伤。此外，酒精在胰腺内氧化代谢时产生大量活性氧，也有助于激活炎症反应，从而引发急性胰腺炎（P429）。胆道结石病（C错）是我国急性胰腺炎最常见的致病因素，而暴饮暴食（A错）是急性胰腺炎最常见的诱因。甲状旁腺功能亢进（E错）可导致高钙血症，胰管钙化，胰液引流不畅，引起慢性胰腺炎急性发作。